下列除哪项外，均是采集主诉所要求的内容
A. 主诉是迫使患者就医的最主要的症状
B. 一般不超过20个字
C. 确切的主诉常可作为诊断的向导
D. 记录主诉，尽量使用诊断术语
E. 症状不突出者，可把就医作为的主要目的主诉

正确答案：D。记录主诉，尽量使用诊断术语

解析：主诉为患者感受最主要的痛苦或最明显的症状或（和）体征，也就是本次就诊最主要的原因及其持续时间（A对）。确切的主诉可初步反映病情轻重与缓急，并提供对某系统疾患的诊断线索（C对）。主诉应用一两句话加以概括，一般不超过20个字（B对）。记录主诉要简明，应尽可能用患者自己描述的症状，而不是医师对患者的诊断用语（D错，为本题正确答案）。对于症状不突出者，可把就医的主要目的作为主诉（E对）。